男，40岁。腹胀、腹部持续性隐痛、发热一周。“肝炎”史12年，近4年来乏力纳差，面色晦暗，间断性齿龈出血。查体：腹部膨隆，无肌紧张，全腹压痛及反跳痛，肝未触及，脾肋下3cm，移动性浊音阳性。为明确诊断，最有价值的检查是
A. 腹水常规生化及细菌培养
B. X线结肠钡剂造影
C. 腹部CT
D. 腹部X平片
E. 肝功能

正确答案：A。腹水常规生化及细菌培养

解析：该患者考虑诊断为自发性细菌性腹膜炎，最有价值的检查为腹水常规生化及细菌培养（A对）。腹水常规生化可鉴别腹水的性质，细菌培养可找到致病菌，明确诊断并指导治疗。X线结肠钡剂造影（B错）用于诊断肠道疾病，如结肠炎，结肠癌等。腹部CT（C错）及腹部X平片（D错）影像学检查可显示肝脏肿大、腹腔炎症、腹腔或盆腔脓肿、包块等基本病变表现，不能诊断自发性细菌性腹膜炎。肝功能（E错）用于判断肝脏功能状态，不能诊断自发性细菌性腹膜炎。